性味苦寒的药物大多具有的功效是
A. 祛风除湿
B. 芳香化湿
C. 清热燥湿
D. 利水渗湿
E. 活血通络

正确答案：C。清热燥湿

解析：清热燥湿药性味苦寒，苦能燥湿，寒能清热（C对）。祛风除湿、活血通络药味多辛苦，性温或凉；辛能散能行，苦味燥湿（AE错）。芳香化湿药辛香温燥，芳香之品能醒脾化湿，温燥之药可燥湿健脾。同时，其辛能行气，香能通气，能行中焦之气机，以解除因湿浊引起的脾胃气滞之病机（B错）。利水渗湿药味多甘淡或苦，淡能渗利，苦能降泄（D错）。